男性，56岁。反复上腹部痛，多在餐后很快发作，不易用酸剂控制，每次发作时频繁呕吐。最常用的治疗方法
A. 手术
B. 抗酸剂治疗
C. 抗生素治疗
D. 铋剂
E. 联合治疗

正确答案：A。手术

解析：老年男性患者，反复上腹部痛，餐后很快发作，每次发作时频繁呕吐，不易用抑酸剂控制（溃疡发在幽门管，进食后食物不能快速通过幽门进入肠道，表现为餐后很快发生疼痛，早期出现呕吐，对药物治疗反应差），考虑诊断为幽门管溃疡。幽门管溃疡对药物治疗反应差，易出现梗阻、出血、穿孔等并发症，抗酸剂治疗无效（B错），需手术治疗（A对）。抗生素（C错）、铋剂（D错）、联合治疗（E错）主要用于Hp相关胃炎的治疗。